不得参与药品生产经营活动，不得以其名义推荐或者监制、监销药品的是
A. 地方人民政府和药品监督管理部门
B. 国务院或者省级人民政府的药品监督管理部门
C. 药品监督管理部门及其设置的药品检验机构
D. 药品监督管理部门及其设置的药品检验机构的工作人员
E. 药品生产、经营企业和医疗机构的药品检验机构或者人员

正确答案：C。药品监督管理部门及其设置的药品检验机构

解析：本题考查药品监督管理。不得参与药品生产经营活动，不得以其名义推荐或者监制、监销药品的是药品监督管理部门及其设置的药品检验机构（C对）。地方人民政府和药品监督管理部门（A错）不得以要求实施药品检验、审批等手段限制或者排斥非本地区药品生产企业依照本法规定的药品进入本地区。国务院或者省人民政府的药品监督管理部门（B错）对已确认发生严重不良反应的药品，可以采取停止生产、销售、使用的紧急控制措施。药品监督管理部门及其设置的药品检验机构的工作人员（D错）不得参与药品生产经营活动。药品生产、经营企业和医疗机构的药品检验机构或者人员（E错）应当接受当地药品监督管理部门设置的药品检验机构的业务指导。